小儿末梢血中性粒细胞和淋巴细胞的比例相等的时间分别是
A. 1～3天和1～3岁
B. 4～6天和4～6岁
C. 7～9天和7～9岁
D. 10～12天和10～12岁
E. 13～15天和13～15岁

正确答案：B。4～6天和4～6岁

解析：小儿末梢血中性粒细胞和淋巴细胞的比例相等的时间分别是4-6天和4-6岁（B对）。